慢性硬化性下颌下腺炎检查时压迫患侧腺体，导管口流出的液体为
A. 絮状唾液
B. 少量黏稠而有咸味液体
C. 胶冻状液体
D. 黏稠脓性分泌物
E. 含有“硫磺颗粒”的脓液

正确答案：D。黏稠脓性分泌物

解析：慢性硬化性下颌下腺炎在检查时若压迫腺体，导管口流出黏稠的脓性分泌物。掌握“坏死性唾液腺化生与舍格伦综合征”知识点。